关于药物含量测定的说法错误的是
A. 含量限度是指按规定方法检测有效物质含量的允许范围
B. 药物含量测定不允许使用除《中国药典》规定方法之外的其他方法
C. 采用化学方法测定含量的药物，其含量限度用有效物质所占的百分数表示
D. 采用生物学方法测定效价的药物，其含量限度用效价单位表示
E. 原料药物的含量限度未规定上限时，系指含量不超过101.0%

正确答案：B。药物含量测定不允许使用除《中国药典》规定方法之外的其他方法

解析：本题考查含量测定。含量测定可以采用其他方法（B错，为本题正确答案），采用其他方法时应与规定方法做比较试验，根据试验结果掌握使用，仲裁时仍以《中国药典》规定的方法为准。